能与激动药竞争相同受体，其结合是可逆的。通过增加激动药的剂量与拮抗药竞争结合部位，可使量效曲线平行右移，但最大效能不变
A. 完全激动药
B. 维生素
C. 非竞争性拮抗剂
D. 竞争性拮抗药
E. 部分激动药

正确答案：D。竞争性拮抗药

解析：根据拮抗药与受体结合是否具有可逆性而将其分为竞争性拮抗药和非竞争性拮抗药。竞争性拮抗药能与激动药竞争相同受体，其结合是可逆的。通过增加激动药的剂量与拮抗药竞争结合部位，可使量效曲线平行右移，但最大效能不变。掌握“药物与受体、剂量与效应关系”知识点。